下列关于艾滋病传播的途径，错误的表达是
A. 通过性接触传播
B. 通过血液传播
C. 通过母婴传播
D. 握手等日常生活接触不传播
E. 可通过蚊虫叮咬传播

正确答案：E。可通过蚊虫叮咬传播